女，25岁阴道分泌物增多5天，G2P2，妇科检查：阴道分泌物呈灰白色，稀薄状，有腥臭味，阴道黏膜无明显充血，支持该疾病诊断的检查结果是
A. 阴道分泌物pH<4.5
B. 胺臭味试验阴性
C. 阴道分泌物镜检见阴道毛滴虫
D. 线索细胞阳性
E. 阴道分泌物镜检白细胞较多

正确答案：D。线索细胞阳性

解析：患者青年女性，妇科检查：阴道分泌物增多，呈灰白色，稀薄状，有腥臭味（细菌性阴道病典型特征），阴道黏膜无明显充血，考虑诊断为细菌性阴道病。该病主要病原体为加德纳菌及其他厌氧菌。实验室检查发现线索细胞（即加德纳菌及其他厌氧菌黏附于阴道脱落鳞状上皮细胞的细胞）（D对），极少白细胞（E错），阴道分泌物pH＞4.5（A错），胺试验阳性（A错）。阴道分泌物镜检见阴道毛滴虫（C错）见于滴虫阴道炎。